男性，47岁，发热伴胸部持续性疼痛3天，胸骨左缘第三、四肋间收缩期和舒张期均可听到粗糙呈搔抓样声音。两天后杂音消失，心音变得弱而遥远应考虑
A. 病情好转
B. 胸腔积液
C. 心包积液
D. 心脏扩大
E. 心力衰竭

正确答案：C。心包积液